在我国尚未列入献血者血液筛査的病原体是
A. 艾滋病病毒
B. 巨细胞病毒
C. 乙型肝炎病毒
D. 丙型肝炎病毒
E. 梅毒螺旋体

正确答案：B。巨细胞病毒

解析：根据《GB 18467-2011 献血者健康检查要求》，我国献血者血液筛查的病原体包括艾滋病病毒（A错）、乙型肝炎病毒（C错）、丙型肝炎病毒（D错）、梅毒螺旋体（E错）等，而不包括巨细胞病毒（B对）。